以零级速率释放药物的经皮吸收制剂的类型有
A. 膜控释型
B. 聚合物骨架型
C. 微孔骨架型
D. 复合膜型
E. 多储库型

正确答案：A、D、E。膜控释型；复合膜型；多储库型